女性，50岁。对称性多关节肿痛伴晨僵1年余，血RF1：40（+），ESR100mm/h，本患者目前暂不考虑的治疗措施是
A. 非甾体抗炎药
B. 强的松
C. 环磷酰胺
D. 甲氨蝶呤
E. 关节手术

正确答案：E。关节手术

解析：中年女性患者，对称性多关节肿痛伴晨僵1年余（类风湿关节炎常见症状），血RF1：40（+）（类风湿关节炎典型免疫学异常），ESR100mm/h（成年女性正常值0-20mm/h），初步诊断为类风湿关节炎。类风湿性关节炎治疗措施包括一般性治疗、药物治疗及外科治疗。药物治疗主要包括①非甾体类抗炎药（A对）；②改变病情抗风湿药如甲氨蝶呤（D对）（为RA的首选用药）、环磷酰胺（C对）；③糖皮质激素（B对）；④生物制剂等。手术治疗（E错，为本题正确答案）多用于经内科治疗不能控制及严重关节功能障碍的类风湿关节炎患者。治疗优先顺序：非甾体抗炎药，改善症状的抗风湿药物（甲氨蝶呤，环磷酰胺），生物制剂，糖皮质激素，手术治疗。